最早可在幼儿时发生的牙龈病是
A. 慢性龈缘炎
B. 增生性龈炎
C. 遗传性牙龈纤维瘤病
D. 牙龈瘤
E. 药物性牙龈增生

正确答案：C。遗传性牙龈纤维瘤病

解析：本题考查最早可在幼儿时发生的牙龈病。1～3岁者称之为幼儿。遗传性牙龈纤维瘤病（C对）最早可发生在乳牙（出生后6～8个月开始）萌出后。慢性龈炎又称边缘性龈炎、慢性龈缘炎（A错），在儿童和青少年中患病率较高，到青春期时达高峰；临床上有一部分慢性龈缘炎患者以牙龈组织的炎性肿胀为主要表现，同时伴有细胞和胶原纤维的增生，在过去曾被称之为“增生性龈炎”（B错）。牙龈瘤（D错）常发生于中、青年，患者女性较多。药物性牙龈增生（E错）是由于长期服用某些药物而引起，常发生于有全身系统性疾病而长期服用某些药物的患者。